《精神卫生法》规定承担精神障碍患者再次诊断的精神科执业医师人数是
A. 5人
B. 2人
C. 4人
D. 1人
E. 3人

正确答案：B。2人

解析：当患者及其监护人对诊断结论有异议，提出再次诊断要求时，承担再次诊断的医疗机构应当在接到再次诊断要求后指派2名初次诊断医师以外的精神科职业医师进行再次诊断（B对）。